婴儿接种百白破疫苗第3针的年龄是
A. 3月龄
B. 4月龄
C. 5月龄
D. 6月龄
E. 8月龄

正确答案：C。5月龄

解析：本题考查百白破疫苗的接种时间。百白破疫苗共接种4剂次， 分别于3、4、5（C对ABDE错）、18月龄各接种1剂。